下列哪一项可诊断为闭经
A. 月经3个月一至，无其他不适
B. 月经1年一行，无其他不适
C. 月经停闭4个月，小腹膨隆，脉滑利
D. 产后3～5个月，从未来经
E. 既往月经不调，现7月未行

正确答案：E。既往月经不调，现7月未行

解析：闭经的诊断，有月经初潮延迟及月经后期病史；或反复刮宫史、产后出血史、结核病史；或过度紧张劳累、过度精神刺激史；或有不当节食减肥史；或有环境改变、疾病影响、使用药物、放化疗及妇科手术史等。症状表现，女性年逾16岁，虽有第二性征发育但无月经来潮，或年逾14岁，尚无第二性征发育及月经；或月经来潮后停止3个周期或6个月以上（E对）。